积极锻炼属于
A. 日常健康行为
B. 避免有害环境行为
C. 保健行为
D. 预警行为
E. 戒除不良嗜好行为

正确答案：A。日常健康行为